吗啡镇痛作用机制是
A. 阻断脑室，导水管周围灰质的阿片受体
B. 激动脑室，导水管周围灰质的阿片受体
C. 抑制前列腺素合成，降低对致痛物质的敏感性
D. 阻断大脑边缘系统的阿片受体
E. 激动中脑盖前核的阿片受体

正确答案：B。激动脑室，导水管周围灰质的阿片受体

解析：吗啡的镇痛作用：吗啡具有强大的镇痛作用，对绝大多数急性痛和慢性痛的镇痛效果良好，对持续性慢性钝痛作用大于间断性锐痛，对神经性疼痛的效果较差。椎管内注射可产生节段性镇痛，不影响意识和其他感觉。该作用可能与其激动脊髓胶质区、丘脑内侧、脑室及导水管周围灰质的阿片受体有关。掌握“吗啡、哌替啶”知识点。